根据《中华人民共和国刑法》，违法行为情节严重，应按非法经营罪定罪处罚的有
A. 违反国家规定，向吸食毒品者销售麻醉药品
B. 买卖进出口许可证和进出口原产地证明
C. 买卖《药品经营许可证》或药品批准文号
D. 未经许可经营药品
E. 药品广告发布者利用广告对药品作虚假宣传

正确答案：B、C、D。买卖进出口许可证和进出口原产地证明；买卖《药品经营许可证》或药品批准文号；未经许可经营药品

解析：本题考查扰乱市场秩序罪。根据《中华人民共和国刑法》，违法行为情节严重，应按非法经营罪定罪处罚的有买卖进出口许可证和进出口原产地证明（B对）、买卖《药品经营许可证》或药品批准文号（C对）、未经许可经营药品（D对）。《中华人民共和国刑法》第三章破坏社会主义市场经济秩序罪第八节扰乱市场秩序罪第二百二十五条：违反国家规定，有下列非法经营行为之一，扰乱市场秩序，情节严重的，处五年以下有期徒刑或者拘役，并处或者单处违法所得一倍以上五倍以下罚金；情节特别严重的，处五年以上有期徒刑，并处违法所得一倍以上五倍以下罚金或者没收财产：（一）未经许可经营法律、行政法规规定的专营、专卖物品或者其他限制买卖的物品的；（二）买卖进出口许可证、进出口原产地证明以及其他法律、行政法规规定的经营许可证或者批准文件的；（三）未经国家有关主管部门批准，非法经营证券、期货或者保险业务的，或者非法从事资金支付结算业务的；（四）其他严重扰乱市场秩序的非法经营行为。